牙龈切除术及牙龈成形术时，手术刀刃应与牙体长轴呈
A. 0°
B. 20°
C. 30°
D. 45°
E. 90°

正确答案：D。45°

解析：切口：使用15号刀片或斧形龈刀，在已定好的切口位置上，将刀刃斜向冠方，与牙长轴呈45°角切入牙龈，直达袋底下方的根面。掌握“药物性牙龈肥大”知识点。